有肠绞窄的机械性肠梗阻临床征象表现为
A. 剧烈的阵发性腹痛，肠鸣音亢进
B. 腹部明显隆起对称
C. 呕吐物胃肠减压液内有胆汁
D. 腹部X线检查见孤立突出的胀大肠袢，随时间而改变位置
E. 有明显腹膜刺激征

正确答案：E。有明显腹膜刺激征

解析：机械性肠梗阻发生肠绞窄时，由于肠壁血运障碍，可发生肠坏死、穿孔，肠管坏死后的炎性渗出及漏出的消化液刺激腹膜，可出现明显的腹膜刺激征（E对）。绞窄性肠梗阻发病多较急骤，由于肠管发生血运障碍，可引起肠坏死、穿孔，故患者表现为持续性的腹部疼痛，肠鸣音减弱或消失（A错）；腹部呈不对称性隆起（B错），查体可触及绞窄的肠袢；呕吐物和胃肠减压液多为血性液体（C错）；腹部X线检查可见孤立胀大的肠袢，不随时间变化而改变位置（D错）。